药品零售企业在销售时，应查验登记购买者身份证信息，且单次不得超过2个最小包装的是
A. 药品类易制毒化学品
B. 含麻黄碱类复方制剂
C. 第三类易制毒化学品
D. 含可待因复方口服液体制剂

正确答案：B。含麻黄碱类复方制剂

解析：本题考查含麻黄碱类复方制剂的管理。药品零售企业在销售时，应查验登记购买者身份证信息，且单次不得超过2个最小包装的是含麻黄碱类复方制剂（B对）。含麻黄碱类复方制剂的销售管理：2012年9月4日，原国家食品药品监督管理局、公安部、卫生部联合发布《关于加强含麻黄碱类复方制剂管理有关事宜的通知》（国食药监办〔2012〕260号），该通知对含麻黄碱类复方制剂的销售管理作出了新的规定。主要包括以下几个方面。1.将单位剂量麻黄碱类药物含量大于30mg（不含30mg）的含麻黄碱类复方制剂，列入必须凭处方销售的处方药管理。医疗机构应当严格按照《处方管理办法》开具处方。药品零售企业必须凭执业医师开具的处方销售上述药品。2.含麻黄碱类复方制剂每个最小包装规格麻黄碱类药物含量口服固体制剂不得超过720mg，口服液体制剂不得超过800mg。3.药品零售企业销售含麻黄碱类复方制剂，应当查验购买者的身份证，并对其姓名和身份证号码予以登记。除处方药按处方剂量销售外，一次销售不得超过2个最小包装。查验购买者的身份证，系指购买者合法有效的身份证件，包括居民身份证、军人证件、护照等。4.药品零售企业不得开架销售含麻黄碱类复方制剂，应当设置专柜由专人管理、专册登记，登记内容包括药品名称、规格、销售数量、生产企业、生产批号、购买人姓名、身份证号码。5.药品零售企业发现超过正常医疗需求，大量、多次购买含麻黄碱类复方制剂的，应当立即向当地药品监管部门和公安机关报告。6.含麻黄碱类复方制剂的生产企业应当切实加强销售管理，严格管控产品销售渠道，确保所生产的药品在药用渠道流通。7.国家药品监督管理部门于2013年10月29日印发《关于加强互联网药品销售管理的通知》（食药监药化监〔2013〕223号），明确规定含麻黄碱类复方制剂（含非处方药品种）一律不得通过互联网向个人消费者销售。药品类易制毒化学品（AC错）单方制剂和小包装麻黄素，纳入麻醉药品销售渠道经营，仅能由麻醉药品全国性批发企业和区域性批发企业经销，不得零售。自2015年5月1日起，含可待因复方口服液体制剂（D错）（包括口服溶液剂和糖浆剂）已列入第二类精神药品管理。具有经营资质的药品零售企业，销售含可待因复方口服液体制剂时，必须凭医疗机构使用精神药品专用处方开具的处方销售，单方处方量不得超过7日常用量。